按公式计算，10个月婴儿的体重应为
A. 8kg
B. 8.5kg
C. 9kg
D. 9.5kg
E. 9.8kg

正确答案：B。8.5kg

解析：该题考查小儿标准体重的计算。第十版中医儿科学及教材中7～12个月的婴儿体重计算公式为：体重（kg）=7+0.5×（月龄-6）。2022年中医执业医师资格考试指导用书（2022年中医执业医师考试大纲）中7～12个月的婴儿体重计算公式更正为：体重（kg）=6+0.25×月龄。以新大纲为标准，10个月婴儿的体重应为6+0.25×10=8.5（kg）（B对）。